复合树脂充填时，下列哪项洞形要求是错误的
A. 洞缘线及点线角圆钝
B. 前牙可保留无基釉
C. 任何条件下均可不做固位形
D. 洞缘线圆缓
E. 洞缘角制备小斜面

正确答案：C。任何条件下均可不做固位形

解析：本题考查复合树脂充填时的洞形要求。Ⅴ类洞在咬合运动中，受侧方（牙合）运动会在牙颈部产生弯曲力，使充填体与洞壁有分离的趋势，应视情况做固位沟以增加固位力（C错，为本题的正确答案）。洞缘线及点线角圆钝、洞缘线圆缓可避免应力集中，防止充填物在受力时折裂（AD对）。前牙受力小，可适当保留无基釉，以保留更多牙体组织，利于美观（B对）。洞缘角制备小斜面，可增加粘结面积，并有利于美观和减少微渗漏（E对）。